急黄神昏舌绛者，其治法是
A. 清热利湿，佐以泻下
B. 利湿化浊，佐以清热
C. 清热解毒，凉营开窍
D. 健脾和胃，温化寒湿
E. 解表清热利湿

正确答案：C。清热解毒，凉营开窍

解析：神昏为热毒内陷心营；舌绛为肝胆热盛，灼伤津液之象。治宜清热解毒，凉营开窍（C对）。清热利湿，佐以泻下，为黄疸阳黄热重于湿的治法（A错）。利湿化浊，佐以清热，为黄疸阳黄湿重于热的治法（B错）。健脾和胃，温化寒湿，为黄疸阴黄的治法（D错）。解表清热利湿为黄疸阳黄初起见表证者的治法（E错）。